祛风湿药雷公藤的主要药理作用是
A. 抗病原体
B. 抑制免疫功能
C. 调节肠胃功能
D. 调节神经功能
E. 改善血液流变学特性

正确答案：B。抑制免疫功能

解析：本题考查的是雷公藤的药理活性。祛风湿药雷公藤的主要药理作用是抑制免疫功能（B对）。雷公藤的药理作用：雷公藤生物碱类化合物中雷公藤次碱、雷公藤春碱、雷公藤新碱、异雷公藤春碱等具有明显的免疫抑制作用。雷公藤红素具有抗炎和抗肿瘤作用。抗病原体（A错）为黄连的药理作用。黄连的主要功效是清热燥湿、泻火解毒，除抗病原体、抗毒素、解热、抗炎、抗肿瘤作用与功效密切相关外，其他药理作用如抗心律失常、降血压、抑制血小板聚集、抗心肌缺血等是现代对黄连作用的新认识。调节胃肠运动（C错）为枳壳的药理作用。枳壳主含挥发油（主要为柠檬烯）、黄酮类成分（主要为柚皮苷、橙皮苷、新橙皮苷等）及生物碱成分（主要为辛弗林和N-甲基酪胺等）。枳壳和麸炒枳壳水煎液对兔离体肠管、兔离体子宫及小白鼠胃肠运动均有影响，但麸炒品水煎液作用强度低于生品，从而减缓了枳壳对肠道平滑肌的刺激。改善血液流变学（E错）为丹参的药理作用。丹参的药理作用：（1）抗心肌缺血性，抗脑缺血；（2）改善微循环；（3）改善血液流变性、抗血栓；（4）降血脂，抗动脉粥样硬化。药理作用为调节神经功能（D错）的中药，2022年考试指南未明确说明。